从心理或行为角度研究躯体疾病的预防和健康促进，该项工作属于以下哪个范畴
A. 临床心理学
B. 健康心理学
C. 行为医学
D. 心身医学
E. 神经心理学

正确答案：B。健康心理学